根据酸蚀症的临床表现，以下哪种指标能够表示酸蚀的程度
A. 硬组织的缺损程度
B. 牙面的颜色
C. 牙齿的敏感程度
D. 牙齿的松动度
E. 酸蚀指数

正确答案：E。酸蚀指数

解析：酸蚀指数是国内第一份酸蚀症调查，参考了国际某些酸蚀症分级标准后制定，此指数适用于临床和流行病调查用。掌握“酸蚀症”知识点。